疾病因素模型将因素分为如下两个层次
A. 生物学因素和非生物学因素
B. 宿主因素和环境因素
C. 可预防因素和不可预防因素
D. 外围的远因和致病机制的近因
E. 危险因素和保护因素

正确答案：D。外围的远因和致病机制的近因

解析：本题考查疾病因素模型。疾病因素模型将因素分为外围的远因和致病机制的近因（D对ABCE错）两个层次。流行病学的危险因素主要指外围的远因。